医疗机构工作人员上岗工作，必须佩带标牌。标牌除载明本人姓名外，还应载明
A. 性别和年龄
B. 年龄和专业
C. 专业和职务
D. 职务或者职称
E. 职称及科室

正确答案：D。职务或者职称

解析：医疗机构工作人员上岗工作，必须佩带标牌。标牌除载明本人姓名外，还应载明职务或者职称（D对）。